属于宫颈癌ⅡA2的表现为
A. 癌浸润膀胱黏膜或直肠黏膜
B. 可见癌灶最大直径＞4cm
C. 临床可见癌灶最大直径≤4cm
D. 肿瘤累及阴道下1/3，但未达盆壁
E. 癌灶已超出宫颈，但未达盆壁。癌累及阴道，但未达阴道下1/3

正确答案：B。可见癌灶最大直径＞4cm

解析：ⅡA1：可见癌灶最大直径≤4cm。ⅡA2：可见癌灶最大直径＞4cm。掌握“宫颈癌”知识点。